丙型肝炎病毒（HCV）的主要传播途径是
A. 消化道传播
B. 输血传播
C. 虫媒传播
D. 呼吸道传播
E. 直接接触传播

正确答案：B。输血传播

解析：丙型肝炎病毒（HCV）的主要传播途径是输血传播（B对），引起丙型肝炎。血液传播的肝炎病毒还包括乙型肝炎病毒（HBV）和丁型肝炎病毒（HDV），艾滋病等疾病也可经血液传播。消化道传播（A错）的肝炎病毒有甲型肝炎病毒（HAV）和戊型肝炎病毒（HEV）（P21-P23），伤寒、细菌性痢疾等疾病也可经消化道传播。虫媒传播（C错）是流行性乙型脑炎病毒等病原体的传播途径（P86）。呼吸道传播（D错）是流感病毒，鼻病毒等病原体的传播途径（P7）。直接接触传播（E错）是钩端螺旋体、钩虫等病原体的传播途径（P7）。